小儿，咳嗽气喘，喉中哮鸣，咳痰稀白，形寒，无汗，鼻流清涕，苔白腻，脉浮滑。其证候为
A. 痰浊阻肺
B. 寒性哮喘
C. 风寒咳嗽
D. 风寒闭肺
E. 风寒感冒

正确答案：B。寒性哮喘

解析：本病例以咳嗽气喘，喉中哮鸣为主症，故诊断为哮喘。风寒外束，内闭于肺，痰为之动，肃降失司，故咳嗽气喘，形寒，无汗，咳痰稀白，鼻流清涕；痰浊留伏于肺，气道受其阻遏，因而痰气相搏，故喉中哮鸣；苔白腻，脉浮滑，皆为寒痰之象，故其证候为寒性哮喘，治以温肺散寒，化痰定喘（B对）。痰浊阻肺（A错）多见于喘证，临床表现为喘而胸满，咳嗽，痰多黏腻色白，咳吐不利，兼有呕恶，食少，口黏不渴，舌苔白腻脉象滑或濡。风寒咳嗽（C错）临床表现为咳嗽频作，咽痒声重，痰白清稀，鼻塞流涕，恶寒少汗，发热头痛，舌苔薄白，脉浮紧，指纹浮红。风寒闭肺（D错）多发生于肺炎初期，临床表现为恶寒发热，无汗，呛咳气急，痰白清稀，口不渴，咽不红，舌质不红，舌苔薄白，脉浮紧，指纹浮红。风寒感冒（E错）临床表现为发热，恶寒，无汗，头痛，鼻塞流涕，打喷嚏，咳嗽，口不渴，咽部不红，舌淡红，苔薄白，脉浮紧或指纹浮红。